血中H+浓度升高引起呼吸加深加快是因为
A. 直接刺激中枢的呼吸神经元
B. 刺激中枢化学感受器
C. 刺激颈动脉体和主动脉体感受器
D. 刺激颈动脉窦和主动脉弓感受器
E. 刺激心肺感受器

正确答案：C。刺激颈动脉体和主动脉体感受器